有时在（牙合）面可见卡氏尖的牙齿是
A. 上颌第一磨牙
B. 上颌第二磨牙
C. 下颌第一磨牙
D. 下颌第二磨牙
E. 上颌第二前磨牙

正确答案：A。上颌第一磨牙

解析：本题考查上下颌磨牙的外形及临床应用解剖。上颌第一磨牙（A对）的近中舌尖的舌侧偶有第五牙尖，又称卡氏尖。